有关假设检验，下列说法正确的是
A. 检验假设针对的是总体，而不是样本
B. 进行假设检验时，既可只写出H₀或H₁，也可同时写出H₀和H₁
C. H₀为对立假设
D. H₀的内容反映了检验的单双侧
E. 都需先计算出检验统计量后再获得P值

正确答案：A。检验假设针对的是总体，而不是样本

解析：A项,由假设检验的零假设和备择假设可以看出,检验假设针对总体,而不是样本。B项,假设检验时必须同时写出H0和H1。C项,H0为零假设(无效假设),H1为备择假设(对立假设)。D项,H1的内容反映了检验的单双侧。E项,某些检验,例如小样本情况下的二项分布问题,可以直接通过计算出P值得出结论;精确概率法也不需要具体的检验统计量。